关于肺表面活性物质成分和功能的说法正确的是
A. 增加肺泡表面张力
B. 维持肺的回缩力
C. 增大大肺泡的容积
D. 减小小肺泡的压力
E. 有助于维持肺泡的稳定性

正确答案：E。有助于维持肺泡的稳定性

解析：肺表面活性物质有助于维持肺泡的稳定性（E对），降低肺泡表面张力（A错），减小肺泡的回缩力（B错）。肺表面活性物质可以维持肺泡容积的稳定性，在肺泡扩大（吸气）时，表面活性物质的密度减小，肺泡表面张力增加，肺泡的容积减小（C错）；在肺泡缩小（呼气）时，表面活性物质的密度增大，降低表面张力的作用增强，肺表面张力减小（D错），因而可以防止肺泡萎陷。